小鼠经口染毒氰化钾后在十几分钟后死亡，属于
A. 迟发性毒性作用
B. 过敏性反应
C. 高敏感性
D. 速发性毒性作用
E. 特异体质反应

正确答案：D。速发性毒性作用